卡介苗接种后所致结核菌素阳性反应是指硬结直径
A. ＜5mm
B. 5～9mm，3～5天后反应消失
C. 10～15mm，一周后留有色素
D. 15～20mm
E. ＞20mm

正确答案：B。5～9mm，3～5天后反应消失

解析：卡介苗接种后硬结直径5-9mm为阳性（+）（B对），不足5mm为阴性（A错），10-19mm为中度阳性（++）（CD错），≥20mm为强阳性（+++）（E错）。